适用于干咳、咳嗽伴黏稠痰的患者，但不宜长期使用，用药7日症状未缓解应停药的恶心性祛痰药物是
A. 溴己新
B. 氨溴索
C. 乙酰半胱氨酸
D. 氯化铵
E. 羧甲司坦

正确答案：D。氯化铵

解析：本题考查恶心性祛痰药。适用于干咳、咳嗽伴黏稠痰的患者，但不宜长期使用，用药7日症状未缓解应停药的恶心性祛痰药物是氯化铵（D对）。恶心性祛痰药除氯化铵外还有愈创甘油醚、桔梗流浸膏。溴己新（A错）、氨溴索（B错）、乙酰半胱氨酸（C错）从不同途径，分解痰液中的黏液成分，如黏多糖和黏蛋白，使黏痰液化，痰液黏度降低而易于咳出，均适用于痰液黏稠不易咳出的患者。羧甲司坦（E错）用于慢性支气管炎、支气管哮喘等引起的痰液黏稠、咳出困难者。